“大实有羸状”指的是
A. 真虚假实
B. 真实假虚
C. 真寒假热
D. 真热假寒
E. 虚中夹实

正确答案：B。真实假虚

解析：真实假虚，指病机的本质为“实”，但表现出“虚”的临床假象。一般由于邪气亢盛，结聚体内，阻滞经络，气血不能外达，故真实假虚又称为“大实有羸状”（B对）。真虚假实（A错）指病机的本质是“虚”，但表现出“实”。一般由于正气虚弱，脏腑经气不足，推动、激发功能减退所致，称“至虚有盛候”。真寒假热（C错）多指阴盛格阳，指阴气偏盛至极，壅闭于里，寒盛于内，逼迫阳气浮越于外。真热假寒（D错）指阳气偏盛至极，深伏于里，热盛于内，排斥阴气于外的一种病理变化。虚中夹实（E错）指病理变化，以正虚为主，又兼有邪实的病理变化。